多为未经治疗的牙髓炎的牙齿的自然结局是
A. 根尖周肉芽肿
B. 根尖周脓肿
C. 致密性骨炎
D. 急性牙髓炎
E. 牙髓坏死

正确答案：E。牙髓坏死

解析：本题考查急慢性根尖周炎。牙髓坏死（E对）多为未经治疗的牙髓炎的自然结局。牙髓坏死多由于炎症的持续发展形成一个不断扩大的液化坏死区，加上引流不畅，牙髓压力升高，最终使整个牙髓坏死。